链霉素
A. 可引起外周神经炎
B. 可引起视神经炎
C. 有流感样症状
D. 可引起耳鸣、耳聋
E. 可引起关节疼痛

正确答案：D。可引起耳鸣、耳聋